下列试剂中，可用于易炭化物检查的是
A. 盐酸
B. 硫酸
C. 醋酸
D. 丙酮
E. 甲醛

正确答案：B。硫酸

解析：本题考查易炭化物检查法。药物中存在的遇硫酸易炭化或易氧化而呈色的微量有机杂质称为易炭化物。这类杂质多为未知结构的化合物，用硫酸（B对）呈色的方法可以简便地控制它们的含量。